女，53岁。近1年来怕脏，不敢倒垃圾和上厕所。在街上遇到垃圾车也害怕，会反复洗手。自己知道不应该，但不能控制，为此感到苦恼而就诊。首选的治疗药物是
A. 丁螺环酮
B. 氯米帕明
C. 阿普唑仑
D. 奥氮平
E. 利培酮

正确答案：B。氯米帕明

解析：根据患者典型的强迫观念和强迫行为，已明确诊断为强迫障碍，治疗强迫障碍的药物有SSRⅠs和氯米帕明，其中SSRⅠs为目前的一线用药，且氯米帕明因不良反应限制了该药的临床应用，但本题的答案中并未给出SSRⅠs药物，所以对于本题来说，首选用药为氯米帕明（B对）。丁螺环酮（A错）是非苯二氮䓬类抗焦虑药。阿普唑仑（C错）是苯二氮䓬类药物，主要作用为抗焦虑和镇静催眠。奥氮平（D错）和利培酮（E错）都是抗精神病药物，主要用于治疗精神分裂症和预防精神分裂症的复发。